男，28岁。枕部着地，昏迷5分钟后清醒，并自己回到家中，其后出现头痛并逐渐加重伴呕吐，1小时后不省人事，急送医院。查体：BP160/90mmHg，脉率65次/分，呼吸15次/分。浅昏迷，右枕部头皮挫伤，左侧瞳孔4mm，对光反应消失；右侧瞳孔2.5mm，对光反应存在。引起病人浅昏迷左侧瞳孔散大最可能原因是
A. 小脑幕切迹疝
B. 枕骨大孔疝
C. 动眼神经麻痹
D. 右侧视神经损害
E. 颈髓损伤

正确答案：A。小脑幕切迹疝

解析：青年男性患者，枕部外伤，短暂昏迷后清醒，其后出现头痛伴呕吐（颅内压增高的表现），之后再次昏迷（昏迷→中间清醒→昏迷为硬膜外血肿的典型表现）。患者左侧瞳孔4mm（正常值为3～4mm），对光反应消失；右侧瞳孔2.5mm，对光反应存在（患者左侧对光反射消失而右侧正常，提示左侧动眼神经麻痹）。综合该患者的病史及体查，诊断考虑硬膜外血肿并发小脑幕切迹疝（A对）。出现小脑幕切迹疝时，脑干内网状上行激动系统受累导致病人出现浅昏迷；同侧动眼神经受挤压产生动眼神经麻痹症状，表现为左侧瞳孔散大。枕骨大孔疝（B错）较少见于硬膜外血肿的病人，其生命体征紊乱出现较早，而意识障碍出现较晚，且患侧瞳孔表现为忽大忽小。动眼神经麻痹（C错）可出现患侧瞳孔散大，直接和间接对光反射消失，但不会出现昏迷。右侧视神经损害（D错）常表现为视力下降、视野缺损，直接光反射减弱或消失，但间接光反射正常，而且不出现昏迷。颈髓损伤（E错）主要表现为受伤平面以下截瘫，感觉障碍，不出现瞳孔散大、对光反射消失和昏迷等症状。